10岁儿童有意注意时间为
A. 10分钟
B. 15分钟
C. 20分钟
D. 25分钟
E. 30分钟

正确答案：D。25分钟